关于处方的正确描述有
A. 执业医师或执业助理医师为患者诊断、预防或治疗疾病而开具的用药指令
B. 药学技术人员为患者调剂配发药品的凭据
C. 处方开具者与处方调配者之间的书面依据
D. 处方应至少保存半年以便为法院提供证据
E. 药品消耗及药品经济收入结账的凭据

正确答案：A、B、C、E。执业医师或执业助理医师为患者诊断、预防或治疗疾病而开具的用药指令；药学技术人员为患者调剂配发药品的凭据；处方开具者与处方调配者之间的书面依据；药品消耗及药品经济收入结账的凭据